婴儿期“生理性贫血”发生在什么时间
A. 生后15天～1个月
B. 生后1个月～2个月
C. 生后2个月～3个月
D. 生后3个月～4个月
E. 生后4个月～5个月

正确答案：C。生后2个月～3个月

解析：由于婴儿生长发育迅速，循环血量迅速增加等因素，红细胞数和血红蛋白量逐渐降低，至2～3个月（C对）时红细胞降至3.0×10¹²/L左右，血红蛋白量降至100g/L左右，出现轻度贫血，称为“生理性贫血”。